饮片呈短段状，茎略呈方柱形，节略膨大，其上有对生叶痕，’气微，味极苦的是
A. 薄荷
B. 广藿香
C. 荆芥
D. 青蒿
E. 穿心莲

正确答案：E。穿心莲